仙鹤草除收敛止血外，又能
A. 活血定痛
B. 止痢截疟
C. 燥湿止痒
D. 清热生津
E. 消肿生肌

正确答案：B。止痢截疟

解析：本题考查的是仙鹤草的功效。仙鹤草除收敛止血外，又能止痢截疟（B对）。仙鹤草：【功效】收敛止血，止痢，截疟，解毒，杀虫，补虚。三七：【功效】化瘀止血，活血定痛（A错）。白矾：【功效】外用解毒杀虫，燥湿止痒（C错）；内服止血止泻，清热消痰。天花粉：【功效】清热生津（D错），清肺润燥，消肿排脓。白及：【功效】收敛止血，消肿生肌（E错）。